在细菌生长过程中，细菌生长最快，生物学性状最典型的阶段是
A. 迟缓期
B. 对数期
C. 减数期
D. 稳定期
E. 衰退期

正确答案：B。对数期

解析：根据生长曲线，细菌的群体生长繁殖可分为四期：①迟缓期。②对数期又称指数期，细菌在该期生长迅速，活菌数以恒定的几何级数增长，生长曲线图上细菌数的对数呈直线上升，达到顶峰状态。此期细菌的形态，染色性，生理活性等都较典型，对外界环境因素的作用敏感。因此，研究细菌的生物学性状（形态染色，生化反应，药物敏感试验等）应选用该期的细菌。一般细菌对数期在培养后的8～18h。③稳定期。④衰亡期。掌握“细菌的生理”知识点。